比较甲、乙两种方案治疗失眠的效果，把300例病人随机分到两组，每组150例，结果甲组有效105例，乙组有效135例，首选的检验方法是
A. 成组四格表χ²检验
B. 四格表的确切概率法
C. 配对四格表χ²检验
D. 行×列表χ²检验
E. 两样本秩和检验

正确答案：A。成组四格表χ²检验